患者胸部刺痛，固定不移，入夜更甚，时或心悸不宁，舌质紫暗，脉沉涩。治疗宜选用
A. 艾叶
B. 白及
C. 三七
D. 槐花
E. 小蓟

正确答案：C。三七

解析：患者胸部刺痛，固定不移，入夜更甚，时或心悸不宁，舌质紫暗，脉沉涩治以化瘀止血，活血定痛。三七味甘微苦性温，入肝经血分，功善止血，又能化瘀生新，有止血不留瘀，化瘀不伤正的特点，为治瘀血诸证首选药物（C对）。艾叶具有温经止血，散寒调经，安胎的功效，没有化瘀，活血定痛的功能（A错）。白及具有收敛止血，消肿生肌的功效，善治体内外出血证，没有化瘀，活血定痛的功能（B错）。槐花具有凉血止血，清肝泻火的功效，可用治血热妄行所致的各种出血证，没有化瘀，活血定痛的功能（D错）。小蓟具有凉血止血，散瘀解毒消痈的功效，没有化瘀，活血定痛的功能（E错）。